属于骨折专有体征的是
A. 张力性水疱
B. 肿胀疼痛
C. 皮下瘀斑
D. 反常活动
E. 功能障碍

正确答案：D。反常活动

解析：骨折的专有体征包括畸形、反常活动（D对）及骨擦音或骨擦感。张力水泡（A错）、肿胀疼痛（B错）、皮下瘀斑（C错）和功能障碍（E错）均为骨折的一般表现，还可见于很多疾病，不具有特征性。